中风风痰入络证的主方为
A. 天麻钩藤饮
B. 镇肝熄风汤
C. 真方白丸子
D. 独活寄生汤
E. 小续命汤

正确答案：C。真方白丸子

解析：风痰入络证之中风为脉络空虚，风痰乘虚入中，气血闭阻所致，治疗应该用真方白丸子祛风化痰通络（C对）。天麻钩藤饮平肝潜阳，活血通络，为风阳上扰证之中风的代表方（A错）。镇肝熄风汤滋阴潜阳，息风通络，为阴虚风动证之中风的代表方（B错）。独活寄生汤培补肝肾，舒筋止痛，为肝肾亏虚证之痹症的代表方（D错）。小续命汤祛风扶正，温经通络，治疗中风半身不遂，口眼歪斜等（E错）。